制备洗涤红细胞的主要目的是
A. 去除血小板
B. 去除红细胞碎片
C. 去除细菌
D. 去除白细胞
E. 去除血浆蛋白

正确答案：E。去除血浆蛋白

解析：洗涤红细胞内含少量血浆、无功能白细胞及血小板，去除了肝炎病毒和抗A、B抗体，即去除血浆蛋白（E对）。